患者，男性，54岁，慢性咳嗽、咳痰10年，2天前感冒后出现胸闷，呼吸困难，不能平卧，查体：体温39度，颈静脉怒张，肝颈静脉回流症（+），双下肢凹陷性水肿，P₂亢进。造成水肿的机制不包括
A. 抗利尿激素增多
B. 醛固酮增多
C. 肾小球滤过率下降
D. 肾血流量减少
E. 肾小球滤过分数减小

正确答案：E。肾小球滤过分数减小

解析：引起水肿的机制包括1.毛细血管血流动力学改变 (1) 毛细血管内静水压增加。 (2) 血浆胶体渗透压降低。(3) 组织液胶体渗透压增高。(4) 组织间隙机械压力降低 。(5) 毛细血管通透性增强 。2.钠水潴留 (1)肾小球滤过功能降低：①肾小球滤膜通透性降低 ；②球－管平衡失调；③肾小球滤过面积减少；④肾小球有效滤过压下降。(2) 肾小管对钠水的重吸收增加：①肾小球滤过分数 (FF)增加；②醛固酮分泌增加；③抗利尿激素分泌增加。3. 静脉、淋巴回流障碍 多产生局部性水肿，肾小球滤过分数减小不属于引起水肿的机制（E错，为本题的正确答案）。